可授予特殊使用级抗菌的药物处方权的医务人员是
A. 主治医师
B. 住院医师
C. 乡村医师
D. 副主任医师
E. 实习医生

正确答案：D。副主任医师

解析：根据《抗菌药物临床应用管理办法》规定，高级专业技术职务任职资格的医师，可授予特殊使用级抗菌药物处方权，副主任医师（D对）属于高级专业技术职称。中级以上专业职务任职资格的医师，可授予限制使用级抗菌药物处方权，主治医师属于中级专业技术职称（A错）。初级专业技术职务任职的医师，可授予非限制使用级抗菌药物处方权，住院医师（B错）、乡村医师（C错）、实习医生（E错）等属于初级专业技术职务任职的医师。